维持蛋白质分子中α-螺旋和β-折叠中的化学键
A. 肽键
B. 离子键
C. 二硫键
D. 氢键
E. 疏水键

正确答案：D。氢键

解析：维持蛋白质分子中α-螺旋和β-折叠中的化学键为氢键（D对）。维持一级结构的主要是肽键（A错）和二硫键（C错）；维持二级结构的主要是氢键；维持三级结构的是疏水键（E错）、盐键（离子键）（B错）、氢键以及范德华力等；维持四级结构的主要是氢键和离子键。